针对年轻恒牙牙髓炎的治疗原则是
A. 根管治疗
B. 根尖手术
C. 根尖诱导成形术
D. 尽量保髓治疗
E. 拔除

正确答案：D。尽量保髓治疗

解析：本题考查年轻恒牙牙髓治疗的原则。针对年轻恒牙牙髓炎的治疗原则是尽量保髓治疗（D对）。年轻恒牙牙髓治疗的原则是：尽力保存活髓组织，以保证牙根的继续发育和生理性牙本质的形成。如不能保存全部活髓，也应该保存根部活髓，如不能保存根部活髓，也应该保存牙齿。而根尖诱导成形术是针对于年轻恒牙的根尖周疾病采取的治疗措施。